不属于医学心理学相关学科的是
A. 健康心理学
B. 变态心理学
C. 神经心理学
D. 药物心理学
E. 教育心理学

正确答案：E。教育心理学